邪热炽盛，消灼津液，出现高热、烦渴欲饮、尿少便干等症状，其病机为
A. 真虚假实
B. 虚中夹实
C. 真实假虚
D. 实中夹虚
E. 上实下虚

正确答案：D。实中夹虚

解析：本题考查实中夹虚的病机。邪热炽盛，消灼津液，出现高热、烦渴欲饮、尿少便干等症状，其病机为实中夹虚（D对）。实中夹虚：实中夹虚，是指以邪实为主，兼见正气虚损的病机变化。例如，外感热病发展过程中，由于邪热炽盛，消灼津液而形成的实热伤津、气阴两伤病证，出现高热、烦渴欲饮、尿少便干等表现，就属于实中夹虚的病机变化。真虚假实（A错）：又称“至虚有盛候”，是指病机的本质为“虚”，但表现出“实”的临床假象的病机变化。一般是由于正气虚弱，脏腑经络气血不足，功能减退，气化无力所致。例如，脾气虚弱，运化无力，可见脘腹胀满、疼痛等假实征象。又如，老年或大病久病，因气虚推动无力而出现的便秘等。虚中夹实（B错）：虚中夹实，是指以正虚为主，兼夹邪实的病机变化。例如，脾阳不振，运化无权之水肿病，即属此类。这是由于脾失健运，气不化水，水湿停聚，泛溢肌肤所致。因为水湿之邪滞留于体内，故称之为实，但其邪实乃由脾虚不运所致，故其病变变化仍以虚为主，而邪实则居其次，属于虚中夹实的病证。真实假虚（C错）：又称“大实有羸状”，是指病机的本质为“实”，但表现出“虚”的临床假象的病机变化。一般是由于邪气亢盛，结聚体内，阻滞经络，气血不能外达所致。例如，热结肠胃，一方面出现腹痛硬满拒按、大便秘结、潮热、谵语等实热症状，同时因阳气被遏，不能外达，可见面色苍白、四肢逆冷、精神委顿等状似虚寒的假象。